局限于黏膜及黏膜下层的胃癌是
A. 原位癌
B. 浸润型癌
C. 早期癌
D. 进展期癌
E. 晚期癌

正确答案：C。早期癌

解析：消化道管壁由内至外依次可分为黏膜层、黏膜下层、肌层和浆膜层共四层，黏膜层又可分为黏膜上皮层（含基底膜）、黏膜固有层和黏膜肌层三个部分。肿瘤局限于黏膜及黏膜下层时，称为早期癌（C对）。原位癌（A错）指肿瘤局限在黏膜上皮层，未突破基底膜。浸润型癌（B错）指癌组织向胃壁内局限性或弥漫性浸润，与周围正常组织分界不清楚的胃癌。中晚期胃癌（进展期胃癌）是指浸润超过黏膜下层或浸润胃壁全层的胃癌（DE错）。